提出病因假设的目的是为了
A. 肯定病因
B. 代替病因
C. 否定病因
D. 验证病因
E. 探索病因的关联强度

正确答案：D。验证病因